识别转录起始点的是
A. ρ因子
B. 核心酶
C. 聚合酶α亚基
D. σ因子
E. DnaB蛋白

正确答案：D。σ因子